男孩，10个月，因高热7天伴皮疹来院。查体：发育正常，皮肤可见红色斑疹，右颈部淋巴结1.5cm×2cm，咽红，扁桃体Ⅰ度，口唇干红，双肺呼吸音清，心尖区可闻及2/6SM，腹软，肝、脾不大，四肢末端红肿。实验室检査：HB100g/L，WBC13×109/L，N0.78，L0.22，PLT352×109/L，ESR70mm/h，ERP（+），ASO100U。该患儿经用阿司匹林和静脉丙种球蛋白治疗效果不佳，可选用以下哪项治疗
A. 血浆置换
B. 加强抗感染
C. 更换非甾体抗炎药
D. 使用糖皮质激素
E. 以上都不是

正确答案：D。使用糖皮质激素

解析：近来发现在某些对高效静脉丙种球蛋白治疗抵抗的患儿，糖皮质激素治疗取得良好效果，不仅可有效缓解急性期症状，冠状动脉病变发生率亦有降低。用于丙种球蛋白耐药、合并全心炎或无法得到丙种球蛋白时。掌握“川崎病”知识点。